在苯二氮䓬类药物中，催眠、抗焦虑作用强于地西泮的药物是
A. 奥沙西泮
B. 三唑仑
C. 硝西泮
D. 氯氮䓬
E. 艾司唑仑

正确答案：B。三唑仑